男性，56岁，间断性肉眼血尿1月余，镜下有血凝块,无腹痛、发热，无尿频、尿急、尿痛，B超示膀胱新生物，如果B超提示膀胱侧壁有一2cm新生物，乳头状，有蒂，该病例适宜的治疗方式为
A. 根治性膀胱切除
B. 膀胱灌注
C. 膀胱部分切除
D. 经尿道膀胱肿瘤切除
E. 全身化疗

正确答案：D。经尿道膀胱肿瘤切除

解析：中年男性患者，间歇性无痛性肉眼血尿（提示可能有泌尿系肿瘤），B超见膀胱内有一带蒂的新生物（提示膀胱肿瘤），结合患者临床表现和超声检查，应考虑为膀胱癌。该患者新生物2.0cm，乳头状，有蒂（属于表浅的乳头状癌），TNM分期属Ta期。九版外科学膀胱癌：TiS、Ta、T1（非肌层浸润性膀胱癌）：TURBt（经尿道膀胱肿瘤电切术）（D对）+（术后化疗或免疫治疗）。T2-T4（肌层浸润性膀胱癌）：根治性膀胱全切术（A错）+盆腔淋巴结清扫术。无法手术治愈的转移性膀胱癌的首选全身化疗（E错）。八版外科学膀胱癌：Tis（原位癌）可行化疗药物或卡介苗（BCG）膀胱灌注治疗（B错）。Ta、T1期肿瘤行经尿道膀胱肿瘤电切术（TURBt）（D对），术后行膀胱灌注化疗。T2期低级别、局限的肿瘤可经尿道切除或行膀胱部分切除术。T3期低级别、单个局限、如病人不能耐受膀胱全切者可采用膀胱部分切除术（C错）；膀胱浸润性癌行根治性膀胱全切除术（A错）。T4期肌层浸润性癌常失去根治性手术机会，采用姑息性放化学治疗（E错）。